关于《药品生产质量管理规范》（药品GMP）的说法，错误的是
A. 药品GMP作为质量管理体系的一部分，是药品生产管理质量控制的基本要求
B. 药品生产企业应当将药品注册的要求，贯彻到原料采购、药品生产、控制、产品放行以及药品销售的全过程中
C. 药品生产企业应当确定需要进行的确认或者验证工作，以证明有关操作的关键要素能够得到有效控制
D. 药品生产企业应当建立文件管理的操作规程，系统的设计、制定、审核，批准和发放文件

正确答案：B。药品生产企业应当将药品注册的要求，贯彻到原料采购、药品生产、控制、产品放行以及药品销售的全过程中

解析：本题考查质量管理和质量风险管理要求。企业应当建立符合药品质量管理要求的质量目标，将药品注册的有关安全、有效和质量可控的所有要求，系统地贯彻到药品生产、控制及产品放行、贮存、发运的全过程中（B错，为本题正确答案），确保所生产的药品符合预定用途和注册要求。药品GMP作为质量管理体系的一部分，是药品生产管理和质量控制的基本要求（A对）。企业应当确定需要进行的确认或验证工作，以证明有关操作的关键要素能够得到有效控制（C对）。企业应当建立文件管理的操作规程，系统地设计、制定、审核、批准和发放文件（D对）。